测定条件有小的变动时，测定结果不受其影响的承受程度是
A. 准确度
B. 精密度
C. 检测限
D. 线性
E. 耐用性

正确答案：E。耐用性